镜下见囊肿上方为牙龈黏膜所覆盖，囊肿衬里上皮具有缩余釉上皮特征，肉眼见囊肿内含清亮液体或血性液体，为以上哪种疾病的表现
A. 含牙囊肿
B. 根尖周囊肿
C. 鳃裂囊肿
D. 鼻腭管囊肿
E. 萌出囊肿

正确答案：E。萌出囊肿

解析：萌出囊肿发生于覆盖在一个正在萌出的乳牙或恒牙牙冠表面的黏膜软组织内，肉眼见囊肿内含清亮液体或血性液体。镜下见囊肿上方为牙龈黏膜所覆盖，囊肿衬里上皮具有缩余釉上皮特征。掌握“牙源性囊肿”知识点。